细菌性肝脓肿，细菌进入肝脏最常见的途径是
A. 肝动脉
B. 胆道
C. 门静脉
D. 外伤伤口
E. 淋巴系统

正确答案：B。胆道

解析：细菌最常通过胆道（B对）进入肝脏，引起细菌性肝脓肿。细菌可循肝动脉（A错）、门静脉（C错）、淋巴系统（E错）途径进入肝脏，但这并不是最常见途径。开放性肝损伤时，细菌可通过外伤伤口（D错）进入肝脏，但这不是最常见途径。